腹部手术后，原则上鼓励早期活动，其理由不包括
A. 促进切口愈合
B. 改善全身血液循环
C. 减少深静脉血栓形成
D. 减少肺部并发症
E. 减少腹腔感染

正确答案：E。减少腹腔感染

解析：腹部手术后，如果镇痛效果良好，原则上应早期床上活动，争取在短期内起床活动。早期活动可以促进切口愈合（A对）、改善全身血液循环（B对）、减少深静脉血栓形成（C对）及减少肺部并发症（D对）等，但早期活动不可以减少膜腔感染（E错，为本题正确答案）。